下列肌肉中，哪一个不属喉肌
A. 环杓后肌
B. 环杓侧肌
C. 环甲肌
D. 甲杓肌
E. 甲状舌骨肌

正确答案：E。甲状舌骨肌

解析：如表所示，喉肌不包括甲状舌骨肌（E对）。